耳、肾毒性最大的氨基苷类抗生素是
A. 卡那霉素
B. 庆大霉素
C. 西索米星
D. 奈替米星
E. 新霉素

正确答案：E。新霉素